非劳动年龄人口与劳动年龄人口数之比是指什么，用来说明人口年龄构成对人口经济活动的影响
A. 老年人口系数
B. 少年人口系数
C. 老龄化指数
D. 总抚养比
E. 老年人口抚养比

正确答案：D。总抚养比